患者，男，40岁。呕血、黑便2天，晕厥一次，患者面色苍白，四肢湿冷，心率110次/分，血压90/60mmHg，小便少，估计失血量是
A. 400mL
B. 500mL
C. 600mL
D. 700mL
E. 800mL

正确答案：E。800mL

解析：胃十二指肠溃疡出血临床上除了可能呕血外，主要症状是解柏油样大便，同时伴有不同程度的贫血和休克症状。胃十二指肠溃疡出血失血量在400mL时，出现休克代偿期，面色苍白，口渴，脉搏快速有力，血压正常或稍高，当失血在800mL时，可出现明显休克现象，出冷汗，脉搏细快，呼吸浅促，血压下降（E对ABCD错）。